男性，50岁。咳嗽，咳白色泡沫痰10年，每年持续4个月。近3年出现活动后气短，时有哮端。体检：两肺叩诊高清音，呼吸音低，呼气延长。慢性肺心病形成肺动脉高压的主要机制是
A. 支气管感染
B. 红细胞增多
C. 血液黏稠度增加
D. 肺小动脉痉挛
E. 肺毛细血管床减少

正确答案：D。肺小动脉痉挛